夏季用前宜在冰箱冷藏室放置15分钟的剂型是
A. 软膏剂
B. 含漱剂
C. 直肠栓剂
D. 滴眼剂
E. 透皮贴剂

正确答案：C。直肠栓剂

解析：本题考查直肠栓剂。夏季用前宜在冰箱冷藏室放置15分钟的剂型是直肠栓剂（C对）。在夏季，炎热的天气会使栓剂变得松软而不易使用，应用前宜将其置入冰水或冰箱中10～20分钟，待其基质变硬。软膏剂（A错）涂敷前将皮肤清洗干净，对有破损、溃烂、渗出的部位一般不要涂敷，涂布部位有烧灼或瘙痒、发红、肿胀、出疹等反应，须立即停药，并将局部药物洗净。含漱剂（B错）多为水溶液，含漱后不宜马上饮水和进食，以保持口腔内药物浓度。滴眼剂（D错）应用时应注意：清洁双手，将头部后仰，眼向上望，用食指轻轻将下眼睑拉开成一钩袋状，将药液从眼角侧滴入眼袋内，一次滴1～2滴。滴药时应距眼睑2～3cm，勿使滴管口触及眼睑或睫毛，以免污染。透皮贴剂（E错）用前将所要贴敷部位的皮肤清洗干净，并稍稍晾干，皮肤有破损、溃烂、渗出、红肿的部位不要贴敷。